碘解磷定的临床应用特点是
A. 须根据病情，足量、重复使用
B. 须口服给药
C. 须与新斯的明合用
D. 对敌百虫、敌敌畏中毒效果较好
E. 中毒早期须快速静脉注射给药

正确答案：A。须根据病情，足量、重复使用

解析：本题考查碘解磷定。碘解磷定的临床应用特点是须根据病情，足量、重复使用（A对）。碘解磷定主要在肝中代谢，代谢物与原药均能很快从肾脏排出，必须足量、重复给药，才能达到预期效果。碘解磷定因含碘，刺激性大，必须静脉给药（B错）。静脉注射过速可引起轻度乏力、眩晕、头痛、恶心、呕吐、视物模糊、复视和心动过速等，故静脉注射宜缓慢（E错）。新斯的明为易逆性胆碱脂酶抑制剂，碘解磷定为胆碱酯酶复活剂，二者作用相反，不可合用（C错）。碘解磷定对不同的有机磷中毒疗效有差异，如对内吸磷、对硫磷、，马拉硫磷中毒的疗效较好，对敌百虫、敌敌畏中毒的疗效稍差（D错）。